土壤氮素循环的主要过程包括
A. 硝化作用、氧化作用、反硝化作用
B. 氨化作用、硝化作用、反硝化作用
C. 氨化作用、硝化作用、腐殖化作用
D. 硝化作用、微生物作用、腐殖化作用
E. 氧化作用、微生物作用、腐殖化作用

正确答案：B。氨化作用、硝化作用、反硝化作用

解析：本题考查土壤氮素循环的主要过程。含氮有机物在土壤微生物的作用下，使含氮有机质分解，是土壤氮素循环的主要过程。其过程主要包括：1.氨化作用：指微生物分解有机氮化合物释放出氨的过程；2.硝化作用：指微生物氧化氨为硝酸并从中获得能量的过程，也称硝化过程；3.反硝化作用（B对ACDE错）：指在厌氧条件如水淹、有机质含量过高情况下，微生物将硝酸盐还原为还原态含氮化合物或分子态氮的过程，也称反硝化过程。